全冠龈边缘过长的主要临床表现是
A. 戴入后牙龈苍白
B. 固位差
C. 边缘可探及悬突
D. 就位困难
E. 外形凸

正确答案：A。戴入后牙龈苍白

解析：若冠边缘过长，对牙龈组织可造成压迫，受压的牙龈组织出现苍白，患者有压痛感，应做相应的调整。掌握“修复体试戴、磨光与粘固”知识点。